患者，女，20岁。突然发作上腹痛，按压后疼痛程度减轻。应首先考虑的是
A. 胃溃疡
B. 胃痉挛
C. 胃炎
D. 急性胃扩张
E. 胃穿孔

正确答案：B。胃痉挛

解析：胃痉挛为胃部的肌肉抽搐，按压后可使胃部肌肉放松，疼痛减轻，患者腹痛，按压后疼痛程度减轻，应首先考虑的是胃痉挛（B对）。胃溃疡（A错）、胃炎（C错）、急性胃扩张（D错）、胃穿孔（E错）出现的上腹痛，按压时疼痛加重。